分子中的硝基在细胞内无氧环境中被还原成氨基，从而抑制病原体DNA合成，发挥抗厌氧菌作用的药物是
A. 链霉素
B. 红霉素
C. 磺胺类
D. 甲硝唑
E. 青霉素

正确答案：D。甲硝唑

解析：甲硝唑分子中的硝基在细胞内无氧环境中被还原成氨基，从而抑制病原体DNA合成，发挥抗厌氧菌作用。掌握“磺胺类及甲硝唑”知识点。